降钙素的主要生理功能是
A. 促进钙磷经肠道吸收作用增强
B. 抑制肾曲小管对磷的吸收，增进对钙的重吸收
C. 抑制骨盐溶解，使血清钙含量降低
D. 使7-脱氢维生素D₃变为维生素D₃
E. 促进维生素D₃转化为25-羟维生素D₃

正确答案：C。抑制骨盐溶解，使血清钙含量降低

解析：本题考查降钙素的生理功能。降钙素的主要生理功能是抑制骨盐溶解，使血清钙含量降低（C对ABDE错）。降钙素是甲状腺滤泡旁细胞分泌的，其生理功能为：降钙素主要可以促进成骨细胞的活动，抑制骨盐溶解，减少肾小管对镁、钠、钙、磷等离子的重吸收，促使尿液中排出更多的尿钙和磷，降低血钙与血磷，还可以用来治疗绝经妇女或老年人骨量丢失过多引起的骨质疏松症。